丙戊酸钠的临床应用是
A. 剧烈疼痛
B. 帕金森病
C. 癫痫小发作
D. 精神分裂症
E. 风湿性关节炎

正确答案：C。癫痫小发作

解析：本题考查丙戊酸钠。丙戊酸钠为一广谱抗癫痫药，临床用于各型癫痫，对失神性发作（小发作）（C对）疗效最好。剧烈疼痛（A错）选用强效镇痛药，如芬太尼、吗啡等。帕金森病（B错）选用左旋多巴、卡比多巴、司来吉兰等。精神分裂症（D错）选用氯丙嗪、氯氮平、舒必利等。风湿性关节炎（E错）选用非甾体抗炎药，如阿司匹林、萘普生等。